可损伤心脾的因素是
A. 劳力过度
B. 劳神过度
C. 房劳过度
D. 过饥
E. 过饱

正确答案：B。劳神过度

解析：劳神过度，又称“心劳”，指长期用脑过度，思虑劳神而积劳成疾。心藏神，脾主思，血是神志活动的重要物质基础，故劳神过度，长思久虑，则易耗伤心血，损伤脾气，以致心神失养，神志不宁而心悸健忘，失眠多梦，以致脾失健运而纳少，腹胀，便溏等（B对）。劳力过度，又称"形劳"，指长时间的过度用力，劳伤形体，积劳成疾，或病后体虚，勉强劳作而致病，劳力过度易耗气，易伤筋骨（A错）。房劳过度，又称“肾劳”，指房事太过，或手淫恶习，或妇女早孕多育等耗伤肾精、肾气而致病（C错）。过饥，指摄食不足，如饥而不得食，或节食过度，或因脾胃功能虚弱而纳少，或因七情内伤而不思饮食，或不能按时饮食而致气血亏虚，脏腑组织失养，功能衰退，全身虚弱，正气不足，抗病力而致他病（D错）。过饱，指饮食过量超过脾胃的承受能力，如暴饮暴食，或中气虚弱二强食，以致脾胃难以消化转输而引起疾病（E错）。